下列哪项不是寿胎丸的组成药物
A. 菟丝子
B. 杜仲
C. 桑寄生
D. 川断
E. 阿胶

正确答案：B。杜仲

解析：寿胎丸由菟丝子、续断、桑寄生、阿胶组成，功能补肾安胎，方中无杜仲（B错，为本题正确答案）。方歌：菟丝四两壮胎气，续断寄生二两胶，食少炒术脂地补，气虚下陷参芪调。